细胞内含量最丰富的RNA是
A. miRNA
B. mRNA
C. tRNA
D. rRNA
E. hnRNA

正确答案：D。rRNA